胸导管注入
A. 左静脉角
B. 右静脉角
C. 乳糜池
D. 右颈干
E. 左颈干

正确答案：A。左静脉角

解析：胸导管起自乳糜池，在左颈总动脉和左颈内静脉的后方转向前内下方，注入左静脉角（A对）。